胆汁质气质的人，其高级神经活动类型属于
A. 强、均衡而灵活的活泼型
B. 强、均衡而不灵活的安静型
C. 强、不均衡而灵活的兴奋型
D. 弱、不均衡、不灵活的抑制型
E. 弱、均衡、灵活的灵活型

正确答案：C。强、不均衡而灵活的兴奋型

解析：俄国生理和心理学家巴甫洛夫则将这四种气质以神经系统的活动特征来解释，并与希波克拉底提到的四种类型相对应。多血质对应的神经活动类型特点为：强、均衡而灵活的活泼型；黏液质对应的神经活动类型特点为：强、均衡而不灵活的安静型；胆汁质对应的神经活动类型特点为：强、不均衡而灵活的兴奋型；抑郁质对应的神经活动类型特点为：弱、不均衡、不灵活的抑制型。故此题正确答案选C。掌握“人格”知识点。